频繁应用可引起局部组织萎缩的药物是
A. 西地碘含片
B. 替硝唑含漱液
C. 地塞米松粘贴片
D. 氯己定含漱液
E. 左旋咪唑片

正确答案：C。地塞米松粘贴片

解析：本题考查药物的不良反应。频繁应用地塞米松粘贴片（C对）可引起局部组织萎缩，使由皮肤、黏膜等部位侵入的病原菌不能得到控制，引起继发的真菌感染等。伴有甲状腺功能亢进症应避免服用含碘的药物（如胺碘酮、西地碘等）（A错）。替硝唑含漱液（B错）的不良反应少见且轻微，偶有恶心、呕吐、口腔金属味、食欲缺乏等。氯己定（D错）偶可引起接触性皮炎，高浓度溶液有刺激性，含漱剂可使牙齿着色，味觉失调，儿童和青年口腔偶可发生无痛性浅表脱屑损害。左旋咪唑（E错）偶有头晕、恶心、呕吐、腹痛、食欲不振、发热、嗜睡、乏力、皮疹、发痒等不良反应，停药后能自行缓解。个别病人可有白细胞减少症、剥脱性皮炎及肝功损伤。